tRNA的3′端的序列为
A. =-ACC
B. =-ACA
C. =-CCA
D. =-AAC
E. =-AAA

正确答案：C。=-CCA